除另有规定外，应检查融变时限的制剂是
A. 软膏剂
B. 蜡丸
C. 黑膏药
D. 栓剂
E. 凝胶贴膏

正确答案：D。栓剂

解析：本题考查的是栓剂的融变时限。除另有规定外，应检查融变时限的制剂是栓剂（D对）。栓剂的质量要求：融变时限，除另有规定外，脂肪性基质的栓剂应在30分钟内全部融化、软化或触压时无硬芯，水溶性基质的栓剂应在60分钟内全部溶解。重量差异应符合规定，凡规定检查含量均匀度的栓剂，可不进行重量差异检查。栓剂的微生物限度照《中国药典》规定的检查方法检查，应符合规定。软膏剂（A错）的抑菌效力、粒度、装量、无菌、微生物限度等应符合相关规定。蜡丸（B错）的含水量、崩解时限、重量差异、装量差异、装量、微生物限度、药物的定性鉴别与含量测定等应符合相关规定。黑膏药（C错）的软化点、重量差异等应符合相关规定。凝胶贴膏（E错）的含膏量、赋形性、黏附力、含量均匀度、微生物限度等应符合相关规定。